便血紫黯，甚则黑色，腹部隐痛，喜热饮，面色不华，神倦，气短懒言，便溏，舌质淡，脉细。治疗应首选方剂
A. 黄芪建中汤
B. 黄土汤
C. 归脾汤
D. 当归补血汤
E. 无比山药丸

正确答案：B。黄土汤

解析：脾胃虚寒，中气不足，统血无力，血溢肠内，随大便而下，故见便血紫黯，甚则黑色；中虚有寒，寒凝气滞，健运失司故见腹部隐痛，喜热饮；脾胃虚寒，气血不足，故见面色不华，神倦气短懒言，便溏；舌质淡，脉细，均为便血脾胃虚寒的表现，治疗需温阳健脾，养血止血，方药选用黄土汤加减（B对）。黄芪建中汤（A错）可以温中补虚，缓急止痛，用于治疗中焦虚寒之虚劳里急证。归脾汤（C错）可以补脾益气生血，用于治疗脾不统血证。当归补血汤（D错）可以补气生血，用于治疗血虚阳浮发热证。无比山药丸（E错）可以补肾益气，固摄止血，用于治疗肾气不固证。